具有温经止血功效的药物是
A. 侧柏叶
B. 仙鹤草
C. 白及
D. 三七
E. 炮姜

正确答案：E。炮姜

解析：该题考查炮姜的功效。炮姜味苦、涩，性温，归脾、肝经，其功效为温经止血，温中止痛（E对）。